85%（吸氧）。对于该患者最重要的治疗措施是
A. 静脉点滴呼吸兴奋剂
B. 静脉注射10%葡萄糖
C. 静脉点滴3%氯化钠溶液
D. 静脉点滴甘露醇
E. 机械通气

正确答案：E。机械通气

解析：患者为老年男性，有咳嗽、咳痰伴喘息20余年的慢性肺部疾病史（为慢阻肺的标志性症状），考虑诊断为慢性阻塞性肺疾病（COPD）。症状加重1周，意识不清，血氧饱和度在吸氧的条件下为85%，考虑为慢性阻塞性肺疾病引起的肺性脑病，治疗应选择机械通气（E对）纠正血氧含量，加快CO₂的排出。（北京大学医学出版社内科学P164）机械通气的指征是：（1）经积极治疗后病情恶化；（2）意识障碍；（3）呼吸形式严重异常；（4）血气分析提示严重通气和或氧合障碍；（5）PaO₂＜50mmHg，尤其是充分氧疗后＜50mmHg；（6）PaCO₂进行性升高，pH动态下降。静脉点滴呼吸兴奋剂（A错）主要用于以中枢抑制为主的呼吸衰竭。静脉注射10%葡萄糖（B错）主要用于治疗低血糖。静脉点滴3%氯化钠溶液（C错），主要用于治疗低钠血症。甘露醇为脱水剂，静脉点滴甘露醇（D错）主要用于脑水肿的治疗。